关于散剂特点的说法，错误的是
A. 粒径小、比表面积大
B. 易分散、起效快
C. 尤其适宜湿敏感药物
D. 包装、贮存、运输、携带较方便
E. 便于婴幼儿、老人服用

正确答案：C。尤其适宜湿敏感药物

解析：本题考查散剂。散剂的分散度较大，湿热敏感的药物（C错，为本题正确答案）容易吸湿、潮解或变质，故不宜被制成散剂。散剂粒径小，比表面积大（A对）；易分散，起效快（B对）；包装、贮存、运输及携带较方便（D对）；剂量易于控制，便于特殊群体如婴幼儿、老人服用（E对）。